《中华人民共和国药典》2000年版从什么时候开始实施
A. 2000年1月1日
B. 2000年7月1日
C. 2000年12月31日
D. 2001年1月1日
E. 2001年12月31日

正确答案：B。2000年7月1日